产后“三冲”是指
A. 冲肾、冲心、冲胃
B. 冲肾、冲肺、冲肝
C. 冲肺、冲心、冲胃
D. 冲肝、冲心、冲脾
E. 冲胃、冲肺、冲脾

正确答案：C。冲肺、冲心、冲胃

解析：产后“三冲”指产后因感染恶露不下等原因引起的三种危重症候，即：“败血冲心”，“败血冲胃”，“败血冲肺”，合称“三冲”（C对），这里的“败血”即指当下而不下的恶露。